唾液中主要的免疫球蛋白是
A. IgA
B. IgG
C. IgM
D. SIgA
E. IgE

正确答案：D。SIgA

解析：SIgA指的是分泌型IgA，是黏膜免疫系统的主要效应分子。掌握“唾液的分泌和功能”知识点。